固定义齿修复中，右上23缺失，选择哪一种
A. 右上14作基牙
B. 右上14左上1作基牙
C. 右上145左上1作基牙
D. 右上145作基牙
E. 以上均不宜

正确答案：C。右上145左上1作基牙

解析：本题考查两个牙的连续缺失的固定桥设计。固定义齿修复中，右上23缺失，选择右上145左上1作基牙（C对）。固定局部义齿的修复设计时，基牙要有良好的固位与支持作用，基牙牙周膜面积的总和应等于或大于缺失牙牙周膜面积的总和。上颌牙牙周膜面积大小顺序为6734521，上3的牙周膜面积较大，所以基牙也需要有足够的牙周膜面积，且牙缺失时首选近缺隙旁的基牙。右上14做基牙（A错），牙周膜面积总和小于缺失牙右上23牙周膜面积，固位力不足，故不可选择右上14作基牙。右上14左上1也可做基牙（B错），但不如右上145左上1作基牙固位力、远期效果更好，对基牙损伤小。右上145做基牙（D错），牙周膜面积小且固定桥两端受力不均匀时可能会发生翘动。